1996年巴西一血液透析中心肾透析导致60多人死亡，其原因是给病人
A. 使用了含贝毒毒素的水
B. 使用了含西加鱼毒毒素的水
C. 使用了含神经性贝毒毒素的水
D. 使用了含铜绿微囊藻毒素的水
E. 使用了含脂多糖毒素的水

正确答案：D。使用了含铜绿微囊藻毒素的水

解析：本题考查微囊藻毒素的危害。1996年巴西一血液透析中心肾透析导致60多人死亡，其原因是给病人使用了含铜绿微囊藻毒素的水（D对ABCE错）。